符合小胃癌的肿瘤大小是
A. 直径1.6cm
B. 直径1.2cm
C. 直径0.8cm
D. 直径0.4cm
E. 直径2.0cm

正确答案：C。直径0.8cm

解析：小胃癌是直径0.6～1.0cm（C对）的早期胃癌，直径0.4cm（D错）的是早期胃癌的微小癌。